酸枣仁汤的功用是
A. 补肾宁心、安神益智
B. 养血安神、清热除烦
C. 滋阴清热、养血安神
D. 镇心安神、泻火养阴
E. 养心安神、和中缓急

正确答案：B。养血安神、清热除烦

解析：酸枣仁汤方含酸枣仁、甘草、知母、川芎，方中重用酸枣仁养血补肝，宁心安神，茯苓宁心安神，知母滋阴润燥、清热除烦，川芎养血调肝，甘草和中缓急，诸药配伍可养血安神，清热除烦（B对），主治肝血不足，虚热内扰之虚烦不眠证。